新生儿，诊断为单侧完全性唇裂合并单侧完全性腭裂，同时伴有鼻部畸形。最先实施的手术治疗是唇裂整复术，腭裂的正畸治疗应开始于
A. 新生儿无牙期
B. 乳恒牙交替期
C. 恒牙期
D. 腭裂整复术后
E. 唇裂整复术后

正确答案：A。新生儿无牙期

解析：本题考查腭裂的正畸治疗。腭裂患者的治疗除手术外，还应对其牙列畸形进行治疗。对腭裂患儿的正畸治疗应从新生儿开始到成年贯穿整个生长发育期，开始于新生儿无牙期（A对），治疗按时间先后顺序及牙列情况可分新生儿无牙期、乳恒牙交替期（B错）以及恒牙期（C错）三个阶段。从新生儿无牙期，即从出生到3个月内戴上腭托矫治器，可用正畸办法迫使中央的前颌突不过度生长前突，使其有一个正常牙弓。乳恒牙交替期或恒牙期再开始进行腭裂的正畸治疗，由于前颌突过度生长，牙弓变形，则往往效果极差。腭裂整复术约在8～18个月时进行，腭裂的正畸治疗从新生儿出生后开始，在腭裂整复术之前（D错）。唇裂整复术最合适的年龄为3～6月，腭裂的正畸治疗从新生儿出生后开始，在唇裂整复术之前（E错）。